取药材少许，浸入水中，可见橙黄色成直线下降，逐渐扩散，水被染成黄色的是
A. 红花
B. 西红花
C. 菊花
D. 槐花
E. 蒲黄

正确答案：B。西红花

解析：本题考查的是西红花药材的性状鉴别。取药材少许，浸入水中，可见橙黄色成直线下降，逐渐扩散，水被染成黄色的是西红花（B对）。西红花：【性状鉴别】药材呈线形，三分枝。暗红色，上部较宽而略扁平，顶端边缘显不整齐的齿状，内侧有一短裂隙，下端有时残留一小段黄色花柱。体轻，质松软，无油润光泽。干燥后质脆易断。气特异，微有刺激性，味微苦。取本品浸于水中，可见橙黄色呈直线下降，并逐渐扩散，水被染成黄色，无沉淀。柱头呈喇叭状，有短缝；在短时间内，用针拨之不破碎。红花（A错）：【性状鉴别】药材为不带子房的管状花。表面红黄色或红色。花冠筒细长，先端5裂，裂片呈狭条形；雄蕊5，花药聚合呈筒状，黄白色；柱头长圆柱形，顶端微分叉。质柔软。气微香，味微苦。菊花（C错）：【性状鉴别】药材亳菊呈倒圆锥形或圆筒形，有时稍压扁呈扇状。总苞碟状；总苞片卵形或椭圆形，草质，黄绿色或褐绿色，外面被柔毛，边缘膜质。花托半球形，无托片或托毛。舌状花数层，雌性，位于外围，类白色，劲直、上举，纵向折缩，散生金黄色腺点；管状花多数，两性，位于中央，为舌状花所隐藏，黄色，顶端5齿裂，瘦果不发育，无冠毛。体轻，质柔润，干时松脆。气清香，味甘、微苦。槐花（D错）：【性状鉴别】药材皱缩而卷曲，花瓣多散落。完整者花萼钟状，黄绿色，先端5浅裂，花瓣5，黄色或黄白色，近圆形，先端微凹。雄蕊10，其中9个基部连合，花丝细长。雌蕊圆柱形，弯曲。体轻。气微，味微苦。蒲黄（E错）药材的性状鉴别，2022年考试指南未明确说明。